常用与培养基、葡萄糖盐水输液、敷料等的灭菌方法是
A. 焚烧法
B. 烧灼法
C. 巴氏消毒法
D. 煮沸法
E. 高压蒸汽灭菌法

正确答案：E。高压蒸汽灭菌法

解析：高压蒸汽灭菌法可杀灭芽孢（胞）和所有微生物，常用语培养基、葡萄糖盐水输液、敷料及各种耐高温耐湿物品的灭菌。掌握“消毒与灭菌”知识点。